反映水体受病原体污染程度的指标是
A. 细菌总数
B. 总大肠菌群数
C. 甲型肝炎病毒
D. 隐孢子虫
E. 粪大肠菌群数

正确答案：E。粪大肠菌群数

解析：本题考查粪大肠菌群的相关内容。总大肠菌群是指一群需氧及兼性厌氧的在37℃生长时能使乳糖发酵、在24小时内产酸产气的革兰阴性无芽孢杆菌。水体中广泛存在两种大肠菌群，一种是人和其他温血动物如牛、羊、狗等肠道内存在的大肠菌群细菌，称为粪大肠菌群；另一种是土壤、水等自然环境中存在的大肠菌群细菌。由于人粪便中存在的大肠菌群细菌具有指示菌意义，因此粪大肠菌群数（E对ABCD错）可反映水体受病原体污染程度的微生物学指标。